左旋多巴抗帕金森病的作用特点是
A. 奏效较快
B. 作用维持时间短
C. 对轻度及年轻患者疗效较好
D. 对肌震颤的疗效较好
E. 对肌肉僵直及运动困难疗效较差

正确答案：C。对轻度及年轻患者疗效较好

解析：本题考查左旋多巴抗帕金森病的作用特点。左旋多巴的作用特点是：①起效慢（A错），一般需服药后2～3周才显效，1～6个月后疗效达最大（B错）。②对运动困难和肌肉僵直的疗效好（E错），对肌肉震颤的疗效较差（D错），对吞咽困难及认知减退无效。③疗效与黑质纹状体损伤程度相关、轻症患者及较年轻患者疗效好（C对），重症和年老体弱者疗效较差。